治疗癃闭肾气不足证，应首选
A. 膀胱俞、中极、行间、内庭
B. 阴谷、肾俞、三焦俞、气海、委阳
C. 脾俞、胃俞、足三里、血海
D. 三阴交、阴陵泉、膀胱俞、中极
E. 关元、中极、足三里、肾俞

正确答案：B。阴谷、肾俞、三焦俞、气海、委阳

解析：治疗癃闭肾气不足证，当温补肾阳，益气启闭，故取肾经合穴阴谷，配肾俞用补法以振奋肾经气机。又因肾气不足，导致三焦决渎无力，所以在培肾的同时，取三焦俞及其下合穴委阳以通调三焦气机。更灸任脉经穴气海以温补下焦，达到补肾气，理三焦，通尿闭的功效（B对）。行间、内庭以泻为主，不适于肾气不足证（A错）。脾俞、胃俞、足三里、血海以补益脾胃，补气养血为主，不补肾经（C错）。三阴交、阴陵泉为脾经上之穴位，有清利湿热之功，此组穴位用于癃闭湿热下注证（D错）。足三里以补益脾胃为主，不能补益肾气（E错）。